某女，67岁。大便秘结，二三日一行，量少，排出不畅，面色无华，头晕目眩，心悸，口干；舌淡，苔少，脉细涩。宜选用的中成药是
A. 清宁丸
B. 当归芦荟丸
C. 补中益气丸
D. 麻仁丸
E. 槟榔四消丸

正确答案：D。麻仁丸

解析：本题考查大肠液亏证的中成药应用。患者为大肠液亏证，宜选用的中成药是麻仁丸（D对）。大肠液亏证的临床表现及辨证要点：大肠液亏证的临床表现，常见大便秘结干燥，难于排出，往往数日一次，可兼见头晕、口臭等症，脉涩或细，舌红少津或可见黄燥苔。一般以大便干燥难于排出为辨证要点。【中成药应用】麻仁丸。清宁丸（A错）为清热剂，具有清热泻火，通便之功效。主治咽喉肿痛，口舌生疮，头晕耳鸣，目赤肿痛，腹中胀满，大便秘结。当归龙荟丸（B错）【主治】泻火通便的功效。用于肝胆火旺，心烦不宁，头晕目眩，耳鸣耳聋，胁肋疼痛，脘腹胀痛，大便秘结。内伤发热之气虚发热证【症状】发热，热势或低或高，常在劳累后发作或加剧，倦怠乏力，气短懒言，自汗，易于感冒，食少便溏。舌质淡，苔薄白，脉细弱。【中成药应用】常用中成药补中益气丸（C错）（水丸）。胃痛之饮食伤胃证【症状】胃脘疼痛，胀满拒按，嗳腐恶食，或吐不消化食物，吐后或矢气后痛减，大便不爽。舌淡红，苔厚腻，脉滑。【中成药应用】常用中成药槟榔四消丸（E错）（大蜜丸）、开胸顺气丸、沉香化滞丸、加味保和丸